下列叙述哪项不正确
A. 维生素A与视觉有关，缺乏时对弱光敏感度降低
B. 除维生素C外，所有的B族维生素都是辅酶或辅基的前体
C. 成年人没有维生素D的缺乏病
D. 维生素K具有促进凝血的作用，缺乏时凝血时间延长
E. 维生素E是脂溶性的

正确答案：C。成年人没有维生素D的缺乏病

解析：当维生素D缺乏或转化障碍时，儿童骨钙化不良、骨骼变软，称佝偻病。成人可引起骨软化症，孕妇或乳母维生素D缺乏时这种情况特别显著。掌握“脂溶性维生素”知识点。